致病后可出现各种秽浊症状或可阻遏气机的邪气是
A. 风邪
B. 寒邪
C. 火（热）邪
D. 湿邪
E. 燥邪

正确答案：D。湿邪

解析：因湿性秽浊，湿邪致病，易出现分泌物和排泄物秽浊不清的特征。湿为重浊之邪，伤人最易留滞于脏腑经络，阻遏气机，使脏腑气机升降失常，经络阻滞不畅。（D对）。风性轻扬开泄，易袭阳位，风性善行数变，风性主动，风为百病之长（A错）。寒为阴邪，易伤阳气，寒性凝滞，寒性收引（B错）。火邪为阳邪，易扰心神，易伤津耗气，易生风动血，易致阳性疮痈（C错）。燥邪干涩，易伤津液，易伤肺（E错）。